硬脑膜外血肿的典型特征是
A. CT示皮髄质交界处多个点状出血点
B. 伤后逆行性遗忘
C. 鼻出血
D. 伤后当时立即出现的昏迷时间较长
E. 伤后一过性意识清醒或好转

正确答案：E。伤后一过性意识清醒或好转

解析：硬脑膜外血肿的典型特征是伤后一过性意识清醒或好转（E对）。伤后第一次昏迷是由于脑震荡或脑挫裂伤所造成；随着血肿量进一步增加，形成脑疝而再次引起昏迷；若血肿形成速度不是太快，可在两次昏迷之间出现一段清醒期，多数为数小时或稍长，但超过24小时者甚少。CT示皮髄质交界处多个点状出血点（A错）是脑挫裂伤的表现。伤后逆行性遗忘（B错）是脑震荡的典型特征。耳、鼻出血（C错）或脑脊液漏是颅底骨折的主要表现。伤后当时立即出现的昏迷时间较长（D错）可见于急性硬膜下血肿、脑内血肿和部分严重的脑挫裂伤患者。